前置胎盘时阴道流血特征是
A. 无痛性阴道流血
B. 有痛性阴道流血
C. 阴道流血常与外伤有关
D. 宫缩时阴道流血停止
E. 阴道流血量与贫血程度不成正比

正确答案：A。无痛性阴道流血

解析：前置胎盘典型症状为妊娠晚期或临产时，发生无诱因、无痛性反复阴道流血（A对B错）；胎盘早剥典型症状为妊娠中期突发持续性腹痛，伴或不伴阴道流血，贫血程度与阴道流血量不符，且常有外伤史，BCE均为胎盘早剥的特点。妊娠35周以后，子宫生理性收缩频率增加，前置胎盘出血率随之上升（P128）（D错）。